肝病患者忌服的药是
A. 贯众
B. 雷丸
C. 南瓜子
D. 使君子
E. 苦楝皮

正确答案：E。苦楝皮

解析：本题考查苦楝皮的使用注意。肝病患者忌服的药是苦楝皮（E对）。苦楝皮【使用注意】本品苦寒有毒，能伤胃损肝，故不宜过量或持续服用，脾胃虚寒者、肝病患者、孕妇慎服。贯众（A错）【使用注意】本品苦微寒有小毒，故孕妇及脾胃虚寒者慎服。雷丸（B错）【使用注意】本品苦寒，脾胃虚寒者慎服。其杀虫成分为蛋白酶，受热（60℃左右）或酸作用下易被破坏失效，而在碱性环境中使用则作用最强，故入煎剂无驱绦虫的作用。南瓜子（C错）【功效】杀虫。使君子（D错）【使用注意】本品大量服用可致呃逆、眩晕、呕吐等不良反应，故不宜超量服用。若与热茶同服，亦可引起呃逆，故服药时忌饮茶。